存在于TCR或BCR可变区的抗原决定簇是
A. 自身抗原
B. 同种异型抗原
C. 超抗原
D. 独特型抗原
E. 异嗜性抗原

正确答案：D。独特型抗原